下列哪项能够表示抽样误差的大小
A. 构成比
B. 率
C. 可信区间
D. 标准差
E. 标准误

正确答案：E。标准误

解析：抽样调查中，使样本均数（或率）与总体均数（或率）之间出现差别的重要原因之一是存在抽样误差。标准误是用来表示抽样误差的大小。掌握“口腔健康状况调查数据的整理和统计”知识点。